致密性骨炎X线片的描述正确的是
A. 根尖区有界限不清的密度减低区
B. 根尖区呈现斑点状或虫蚀状不规则破坏
C. 骨膜呈“葱皮样”改变
D. 根尖区骨质没有明显变化
E. 根尖区骨密度增高，与正常骨组织分界不清

正确答案：E。根尖区骨密度增高，与正常骨组织分界不清

解析：本题考查急慢性根尖周炎。某些年轻患者在抵抗力很强、感染轻微的低度刺激作用下，肉芽肿可呈现修复性反应，骨小梁增生，骨髓腔缩小，X线片可见一阻射区，与周围正常骨分界不清（E对），此又称为致密性骨炎。